医疗机构发现法定传染病疫情或者发现其他传染病暴发流行时，其疫情报告应当遵循的原则是
A. 属地管理
B. 层级管理
C. 级别管理
D. 特别管理
E. 专门管理

正确答案：A。属地管理

解析：疾病预防控制机构、医疗机构和采供血机构及其执行职务的人员为责任疫情报告人，在发现传染病疫情或者其他传染病暴发、流行以及突发原因不明的传染病时，其疫情报告应当遵循属地管理（A对）原则，按规定报告。